维生素C的鉴别反应是
A. 与硝酸银反应
B. 与2，6二氯靛酚反应
C. 与三氯化铁反应
D. 与茚三酮反应
E. 与碘化汞钾反应

正确答案：A、B。与硝酸银反应；与2，6二氯靛酚反应